患者2个月前患悬饮，经积极治疗，饮邪已退病情好转。现仍胸胁灼痛，呼吸不畅，闷咳，天阴时明显，舌暗苔薄，脉弦。治疗应首选
A. 柴胡疏肝散
B. 柴枳半夏汤
C. 小柴胡汤
D. 香附旋覆花汤
E. 栝蒌薤白白酒汤

正确答案：D。香附旋覆花汤

解析：饮邪久郁之后，气机不利，脉络痹阻，故胸胁灼痛，呼吸不畅，闷咳；天阴寒饮更甚，阻滞气机，故天阴时明显；舌暗苔薄，脉弦，乃为气滞络痹之候，故诊断为络气不和证，治以理气和络，代表方为香附旋覆花汤（D对）。柴胡疏肝散，其功用为疏肝理气，活血止痛，可用于郁证之肝气郁结证（A错）。柴枳半夏汤，其功用为和解清热，宣肺利气，涤饮开结，可用于悬饮之邪犯胸肺证(B错)。小柴胡汤，其功用为和解少阳，适用于伤寒少阳证、热入血室证和黄疸、疟疾及内伤杂病等（C错）。栝蒌薤白白酒汤，其功用为通阳散结，行气祛痰，适用于胸阳不振，痰气互结之胸痹轻证（E错）。